以下不是经接触传播所致传染病的流行特征的选项是
A. 加强传染源管理，严格消毒制度，注意个人卫生可以减少传播
B. 病例一般呈散发和家庭聚集性
C. 流行过程缓慢，全年均可发病，无明显季节性高峰
D. 个人卫生习惯不良和卫生条件差的地区发病较多
E. 有明显的季节性和地区性特点

正确答案：E。有明显的季节性和地区性特点

解析：本题考查经接触传播所致传染病的流行特征。经接触传播所致传染病的流性特征有：①病例多呈散发，但可在家庭或同住者之间传播而呈现家庭和同住者中病例聚集的现象（B对）；②卫生条件差、卫生习惯不良的人群中病例较多（D对）；③流行过程缓慢，全年均可发病，无明显季节性高峰（C对）；④加强传染源管理，严格消毒制度，注意个人卫生可以减少传播（A对）。有明显的季节性和地区性特点（E错，为本题正确答案）是经空气传播的传染病流行特征。